外科术后最常见的并发症是
A. 疼痛
B. 发热
C. 恶心、呕吐
D. 腹胀
E. 呃逆

正确答案：B。发热

解析：发热（B对）是术后最常见的症状，约72%的病人超过37℃；而术后最常见的不适是疼痛（A错）；腹胀（剖腹手术后，胃肠道蠕动减弱，出现腹胀）（D错）、呃逆（神经中枢或膈肌直接受刺激）（E错）也属于术后的不适，而非术后并发症；术后恶心、呕吐（C错）的常见原因是麻醉反应，待麻醉作用消失后即可停止，不是术后常见并发症，而是麻醉后的常见不良反应。